一男性患者，外伤致左侧髁突完全性骨折，此时的髁突向何方移位
A. 向前，向外
B. 向前，向内
C. 向后，向外
D. 向后，向内
E. 向前，向上

正确答案：B。向前，向内

解析：翼外肌呈水平位，起于蝶骨大翼的颞下面、颞下嵴及翼外板的外面，行向后外，止于髁突颈前方的关节翼肌窝。因此髁突完全骨折后，受翼外肌牵引，髁突向前内移位。掌握“咀嚼肌、颈部肌及口颌系统肌链”知识点。